呈扁长卵形、边缘薄、基部钝圆而扁狭，表面黄棕色至红棕色、密布颗粒状的药材是
A. 枸杞子
B. 连翘
C. 桃仁
D. 苦杏仁
E. 酸枣仁

正确答案：C。桃仁

解析：本题考查的是桃仁的性状鉴别。呈扁长卵形、边缘薄、基部钝圆而扁狭，表面黄棕色至红棕色、密布颗粒状的药材是桃仁（C对）。桃仁【性状鉴别】药材呈扁长卵形，长1.2～1.8cm，宽0.8～1.2cm，厚0.2～0.4cm。表面黄棕色至红棕色，密布颗粒状突起。一端尖，中部膨大，另端钝圆稍偏斜，边缘较薄。尖端一侧有短线形种脐，圆端有颜色略深不甚明显的合点，自合点处散出多数纵向维管束。种皮薄，子叶2，类白色，富油性。枸杞子（A错）【性状鉴别】药材呈类纺锤形或椭圆形，长6～20mm，直径3～10mm。表面红色或暗红色，顶端有小突起状的花柱痕，基部有白色的果梗痕。连翘（B错）【性状鉴别】药材呈长卵形至卵形，稍扁，长1.5～2.5cm。表面有不规则纵皱纹和多数突起的小斑点，两面各有1条明显的纵沟。顶端锐尖，基部有小果梗或已脱落。苦杏仁（D错）【性状鉴别】药材呈扁心形，长1～1.9cm，宽0.8～1.5cm，厚0.5～0.8cm。表面黄棕色至深棕色，一端尖，另端钝圆，肥厚，左右不对称，尖端一侧有短线形种脐，圆端合点处向上具多数深棕色的脉纹。酸枣仁（E错）【性状鉴别】药材呈扁圆形或扁椭圆形，长0.5～0.9cm，宽0.5～0.7cm，厚约0.3cm。表面紫红色或紫褐色，平滑有光泽，有的有裂纹。有的两面均呈圆隆状突起；有的一面较平坦，中间有1条隆起的纵线纹，另一面微隆起，边缘略薄。